女，66岁。体检发现血压高，无不适，其父亲于49岁时死于急性心肌梗死。查体：血压155/100mmHg。实验室检查血清总胆固醇590mmol/L，尿蛋白240mg/24h。对该患者高血压的诊断应为
A. 1级，高危
B. 2级，高危
C. 2级，很高危
D. 1级，中危
E. 1级，很高危

正确答案：B。2级，高危

解析：66岁中老年妇女（65岁以上女性，是高血压患者的心血管危险因素），血压高，其父49岁死于急性心肌梗死（心血管病家族史，一级亲属发病年龄男性＜55岁，为高血压患者的心血管危险因素）。查体：血压155/100mmHg（收缩压155mmHg属于1级高血压，舒张压100mmHg属于2级高血压，当收缩压和舒张压分属于不同分级时，以较高的级别作为标准，故该患者属于2级高血压，高血压（1-3级）是心血管危险因素）。实验室检查：血清总胆固醇590mmol/L（血清总胆固醇（TC）≥5.7mmol/L（220mg/dl），是高血压患者的心血管危险因素），尿蛋白240mg/24h（尿微量白蛋白30～300mg/24h，提示靶器官损害）。综上，该患者具有≥3个其他危险因素或靶器官损害，结合2级高血压，可诊断该患者高血压为2级，高危（B对）。